判断慢性肾炎病情程度最有意义的检查是
A. CT
B. B型超声波
C. 内生肌酐清除率
D. 血尿素氮
E. 尿蛋白

正确答案：C。内生肌酐清除率

解析：内生肌酐清除率（C对）可反映肾小球滤过功能和粗略估计有效肾单位的数量，故为测定肾损害的定量试验。因其操作方法简便，干扰因素较少，敏感性较高，为临床常用的较好的肾功能试验之一。由于肾脏代谢功能极强，当内生肌酐清除率降至正常值50%以下时，血清肌酐和血尿素氮（D错）才会升高；尿蛋白（E错）敏感性性较低；CT（A错）、B超（B错）不是判断慢性肾炎病情程度最有意义的检查。